肠道杆菌的共同特征不包括
A. G-杆菌
B. 有菌体抗原
C. 有鞭毛抗原
D. 有荚膜抗原
E. 有芽孢

正确答案：E。有芽孢